肾阳不足，寒邪内侵的腹痛特点是
A. 少腹拘急冷痛
B. 腹中冷痛
C. 脐中痛不可忍
D. 腹中雷鸣切痛
E. 脘腹胀满疼痛

正确答案：C。脐中痛不可忍

解析：脐中痛不可忍，喜按喜温，手足厥逆，脉微欲绝者，为肾阳不足，寒邪内侵，宜通脉四逆汤（C对）。少腹拘急冷痛，苔白，脉沉紧，为下焦受寒，厥阴之气失于疏泄，宜暖肝煎（A错）。腹中冷痛，手足逆冷，而又身体疼痛，为内外皆寒，宜乌头桂枝汤（B错）。腹中雷鸣切痛，胸胁逆满，呕吐，为寒邪上逆，宜附子粳米汤（D错）。